在儿童热能供给中，脂肪所占的适当比例应为
A. 12%～15%
B. 15%～16%
C. 15%～20%
D. 20%～30%
E. 20%～35%

正确答案：D。20%～30%

解析：本题考查儿童热能的脂肪占比。脂肪所提供的能量占总能量比例随年龄的增加而下降，1～3岁幼儿为35%，4～17岁儿童、青少年膳食参考摄入量占总能量的20%～30%（D对ABCE错）。